由Ⅲ型超敏反应引起的疾病是
A. 支气管哮喘
B. 荨麻疹
C. 溶血性贫血
D. 接触性皮炎
E. 血清病

正确答案：E。血清病

解析：血清病（E对）属于Ⅲ型超敏反应的常见疾病。支气管哮喘（A错）和荨麻疹（B错）属于Ⅰ型超敏反应的常见疾病。溶血性贫血（C错）属于Ⅱ型超敏反应的常见疾病。接触性皮炎（D错）属于Ⅳ型超敏反应的常见疾病。